畸形中央尖折断导致牙髓和根尖感染X线片上牙根典型表现
A. 牙根变长
B. 根管变细、根尖孔闭锁
C. 根管钙化
D. 牙根较短根尖孔扩大呈喇叭口形
E. 正常影像

正确答案：D。牙根较短根尖孔扩大呈喇叭口形

解析：本题考查畸形中央尖折断感染后的临床表现。牙根较短根尖孔扩大呈喇叭口形（D对）是畸形中央尖折断导致牙髓和根尖感染X线片上牙根的典型表现。根管变细、根尖孔闭锁（B错）是牙本质发育不全的临床表现，乳恒牙通常呈琥珀色、半透明，显著磨损。牙根变长（A错）大多是牙龈萎缩导致，与不良卫生习惯有关。根管钙化（C错）可能发生在年长的患者牙齿上，也可能是外伤导致的弥漫性钙化。正常影像（E错）可见牙体无异常，不符合畸形中央尖折断牙髓感染的情况。